家居环境铅污染主要与下列哪种家用化学品有关
A. 化妆品
B. 洗涤剂
C. 涂料
D. 黏合剂
E. 杀虫剂

正确答案：C。涂料

解析：本题考查与家居环境铅污染有关的家用化学品。家居环境铅污染主要与含铅涂料（C对ABDE错）有关，含铅涂料也可能是非铅污染区的儿童体内铅含量增加甚至引发铅中毒的重要原因。